医疗卫生机构和有关单位发现有突发卫生事件情形的，向所在地卫生行政部门主管部门报告的时限要求是在发现
A. 2小时后
B. 2小时内
C. 6小时后
D. 4小时后
E. 3小时后

正确答案：B。2小时内

解析：突发事件监测机构、医疗卫生机构和有关单位发现上述需要报告情形之一的，应当在2小时内向所在地县级入民政府卫生行政部门报告；接到报告的卫生行政部门应当在2小时内向本级人民政府报告，并同时向上级人民政府卫生行政部门和国务院卫生行政部门报告。地方人民政府应当在接到报告后2小时内向上级人民政府报告（B对）。